蓝斑神经元中的主要递质是
A. 多巴胺
B. 去甲肾上腺素
C. 肾上腺素
D. 5-羟色胺
E. 谷氨酸

正确答案：B。去甲肾上腺素

解析：蓝斑神经元中的主要递质是去甲肾上腺素（B对）。